下列有关牙髓失活法的叙述中，错误的是
A. 失活法用于去髓治疗麻醉效果不佳的患者
B. 金属砷较亚砷酸安全
C. 金属砷封药时间为10～12天
D. 多聚甲醛失活剂封药时间为2周左右
E. 常用的失活剂多聚甲醛和硝酸银

正确答案：E。常用的失活剂多聚甲醛和硝酸银

解析：本题考查牙髓失活法。下列有关牙髓失活法的叙述中，错误的是常用的失活剂多聚甲醛和硝酸银（E错，为本题正确答案）。牙髓失活法常用三氧化二砷。